苯巴比妥显效慢的主要原因是
A. 吸收不良
B. 体内再分布
C. 肾排泄慢
D. 脂溶性较小
E. 血浆蛋白结合率低

正确答案：D。脂溶性较小

解析：本题考查苯巴比妥。苯巴比妥显效慢的主要原因是脂溶性较小（D对）。苯巴比妥需要通过血脑屏障进入中枢发挥作用，脂溶性较小，不易通过血脑屏障，因此显效慢。